乙琥胺临床用于
A. 抑郁症
B. 失眠
C. 惊厥
D. 癫痫小发作
E. 帕金森病

正确答案：D。癫痫小发作

解析：本题考查乙琥胺的临床应用。乙琥胺是一类较新的抗癫痫药，临床主要用于癫痫小发作（D对）。